患者，女，30岁。左侧乳房疼痛，以胀痛为主，肿块形态不规则，质地中等，表面光滑，活动度好。应首先考虑的中医诊断是
A. 乳痈
B. 乳癖
C. 乳岩
D. 乳发
E. 乳痨

正确答案：B。乳癖

解析：患者，女，30岁，本病多发生于30～50岁妇女。左侧乳房疼痛，以胀痛为主，肿块形态不规则，质地中等，表面光滑，活动度好，诊断为乳腺增生，属中医“乳癖”范畴（B对）。急性乳腺炎的临床特点是乳房结块，红肿热痛。本病属中医“乳痈”范畴（A错）。乳腺癌属中医“乳岩”范畴，临床见浸润性生长的无痛性乳腺肿块、与皮肤粘连、有乳头血性溢液、较大肿块引起乳腺皮肤水肿、橘皮样变、乳头回缩、患侧乳腺抬高等（C错）。乳发指乳房或胸肌之内易于腐烂坏死的化脓性感染。其症初起即乳房（或胸部）焮热漫肿，并有较剧烈的疼痛，伴有恶寒发热，来势凶猛，发展迅速，皮肉焦黑腐烂。妇女常乳房遍溃，囊隔损伤（D错）。乳房结核在中医中称为“乳痨”，本病多由于郁怒伤肝，思虑伤脾，以致气滞痰凝，更兼冲任失调，气血运行不畅，导致乳络而发病，日久蕴热溃腐，穿破成漏，脓汁清稀，夹杂败絮，长期流脓以致耗伤气血，迁延不愈（E错）。